患儿，女，6岁。左侧颈旁肿痛结块3天，皮色未变，肿核形如鸽卵大，活动度不大。外治应首选
A. 冲和膏
B. 金黄膏
C. 青黛膏
D. 红油膏
E. 白玉膏

正确答案：B。金黄膏

解析：颈痈，多见于儿童，初起局部皮色不变、肿胀、灼热、疼痛，肿块边界清楚，具有明显的风温外感症状，本病例肿块特点与之相符，结合患儿年龄，故诊断颈痈，本病例为初起病变，可用鲜蒲公英、鲜紫花地丁、或鲜野菊花叶捣烂外敷，或用金黄膏外敷（B对）。冲和膏，具有活血止痛、祛风散寒、消肿软坚的作用，适用于肿疡期半阴半阳证（A错）。青黛膏，功用为收湿止痒、清热解毒，适用于蛇串疮，急慢性湿疮、炸腮及对各种油膏过敏者（C错）。红油膏和白玉膏，用于颈痈溃后，用九一丹或八二丹药线引流，外盖金黄膏或红油膏；脓尽改用生肌散、白玉膏（DE错）。